关于打结的方法，下列说法错误的是
A. 打结的方法有单手打结、双手打结和持针钳打结3种
B. 单手打结最好练就左、右手均能打结
C. 单手打结多用于口腔内及深部缝合
D. 在缝线过短和缝扎时也常应用持针钳打结
E. 口腔颌面外科手术以单手打结和持针钳打结最为常用

正确答案：C。单手打结多用于口腔内及深部缝合

解析：打结的方法有单手打结、双手打结和持针钳打结3种，口腔颌面外科手术以单手打结和持针钳打结最为常用，前者在结扎和一般缝合时使用，后者则多用于口腔内及深部缝合，在缝线过短和缝扎时也常应用。口腔内打结应打三重结，以防松脱。单手打结最好练就左、右手均能打结。掌握“口外手术打结、缝合及外科引流”知识点。